71岁男性，二年来无诱因逐渐出现行动缓慢，行走时上肢无摆动，前倾屈曲体态。双手有震颤，双侧肢体肌张力增高。无智能和感觉障碍，无锥体束损害征。选用上述治疗的目的是
A. 治愈疾病
B. 阻止疾病的进行
C. 改善症状
D. 预防并发症
E. 增强体质

正确答案：C。改善症状

解析：患者老年男性，2年来无诱因逐渐出现行动缓慢，行走时上肢无摆动（肌张力增高），前倾屈曲体态。双手有震颤，双侧肢体肌张力增高。无智能和感觉障碍，无锥体束损害征，可诊断为帕金森。帕金森病目前应用的治疗手段，无论药物或手术，只能改善症状（C对），不能有效地阻止疾病的进行（B错），更无法治愈（A错）。预防并发症（D错）、增强体质（E错）是考虑因素但都不是治疗目的。